筛检试验的特异度是指
A. 筛检试验阴性者患病的可能性
B. 实际有病，筛检试验被确定为有病的百分比
C. 实际有病，筛检试验被确定为无病的百分比
D. 实际无病，根据筛检试验被确定为无病的百分比
E. 实际无病，根据筛选试验被确定为有病的百分比

正确答案：D。实际无病，根据筛检试验被确定为无病的百分比

解析：筛检试验的特异度是指实际无病，根据筛检试验被确定为无病的百分比（D对）。实际有病，筛检试验被确定为有病的百分比（B错）表示的是筛检试验的敏感度。实际有病，筛检试验被确定为无病的百分比（C错）表示的是筛查实验的假阴性率，又叫做漏诊率，也可以表达成筛检试验阴性者患病的可能性（A错）。实际无病，根据筛选试验被确定为有病的百分比（E错）表示的是筛查实验的假阳性率，也叫做误诊率。本题并不是很难的题目，但涉及到的几种比率的表述非常接近，这种题目要求我们要仔细的审题才能保证正确。